腭裂术后瘘孔（复裂）的主要原因
A. 缝合时张力过大
B. 感染
C. 术后哭闹
D. 软硬腭组织少
E. 外伤

正确答案：A。缝合时张力过大

解析：本题考查腭裂术后瘘孔的原因。腭裂术后创口可能发生裂开或穿孔，常位于硬软腭交界或腭垂处，其主要原因是缝合时张力过大（A对）。感染（B错）、术后哭闹（C错）、软硬腭组织少（D错）、外伤（E错）等因素虽然也可造成腭裂术后创口可能发生裂开或穿孔，但是不常见，不是主要原因。